细菌因其基因组上整合有前噬菌体而获新的性状称为
A. 转化
B. 转导
C. 溶原性转换
D. 接合
E. 原生质体融合

正确答案：C。溶原性转换